苏子降气汤中配伍当归和肉桂的意义是
A. 祛痰止咳
B. 温肾祛寒
C. 温肾纳气
D. 养血补肝
E. 温补下虚

正确答案：E。温补下虚

解析：当归甘、辛，温，能补血活血，调经止痛，润肠通便。肉桂辛、甘，大热，能补火助阳，散寒止痛，温通经脉，引火归元。苏子降气汤功效是降气平喘，祛痰止咳，故当归在该方中辛甘温润，既止咳逆上气，又可养血补虚以助肉桂温补下虚（E对）。